密切接触白喉病人的儿童应给予的免疫措施是
A. 白喉类毒素
B. BCG
C. 白喉抗毒素
D. 丙种球蛋白
E. 胎盘球蛋白

正确答案：C。白喉抗毒素

解析：对于与白喉病人密切接触的儿童应该接种白喉抗毒素，此为白喉杆菌外毒素免疫动物制备的免疫血清，具有中和外毒素毒性的作用。应作为婴儿出生后按计划免疫的一项预防接种制品。掌握“免疫预防及免疫治疗”知识点。